老年人口腔流行病学的龋病常用的指数中一般没有
A. 失牙率
B. 患龋率
C. 龋均
D. 无龋率
E. 根面龋均

正确答案：A。失牙率

解析：成年人因牙周病而失牙的几率较高，因而统计成年人龋失补牙数时有可能将牙周病丧失的牙也计算在内。因此，按照世界卫生组织的记录方法，检查30岁以上者，不再区分是龋病还是牙周病导致的失牙，其失牙数按口腔内实际失牙数计。掌握“龋病流行病学”知识点。